关于膀胱的说法哪个是不对的
A. 膀胱是贮尿器官
B. 膀胱三角是结核和肿瘤的好发部位
C. 膀胱充盈时可在腹膜腔外进行穿刺
D. 膀胱是腹膜外位器官
E. 新生儿位置较成年人高

正确答案：D。膀胱是腹膜外位器官

解析：膀胱是储存尿液的肌性囊状器官（A对），为腹膜间位器官（D错，为本题正确答案），充盈时可在腹膜腔外进行穿刺（C对），不会伤及腹膜和污染腹膜腔，新生儿位置较成年人高（E对）。膀胱三角是肿瘤、结核和炎症的好发部位（B对），膀胱镜检查时应特别注意。